关于气雾剂质量要求的说法，错误的是
A. 无毒
B. 无刺激性
C. 容器应能耐受所需压力
D. 均应符合微生物限度检查要求
E. 应置凉暗处贮藏

正确答案：D。均应符合微生物限度检查要求

解析：本题考查气雾剂质量要求。不是所有的气雾剂都要进行微生物限度检查（D错，为本题正确答案）。气雾剂的质量要求：①无毒性（A对）、无刺激性（B对）；②抛射剂为适宜的低沸点液体；③气雾剂容器应能耐受所需的压力（C对）；④泄露和压力检查应符合规定，确保安全使用；⑤烧伤、创伤、溃疡用气雾剂应无菌；⑥气雾剂应置凉暗处保存（E对），并避免暴晒、受热、敲打、撞击。